银汞合金研磨时间过长可导致
A. 体积膨胀
B. 体积收缩
C. 先收缩后膨胀
D. 先膨胀后收缩

正确答案：B。体积收缩

解析：本题考查银汞合金的性能-体积变化。银汞合金的最终尺寸是膨胀还是收缩在一定程度上取决于最初收缩的程度，如果调和研磨时间过长，最初的收缩很大，以至于随后的膨胀不足于弥补最初的收缩，最终表现为体积收缩（B对CD错），所以银汞合金调和研磨时间越长，银汞合金的体积收缩越大。银汞合金研磨时间较短时体积膨胀（A错）。